在免疫应答中有免疫调节作用的分子不包括
A. C9
B. C3b
C. IL-2
D. IgG
E. IgA

正确答案：A。C9